布洛芬口服混悬液的处方组成：布洛芬、羧丙甲基纤维素、山梨醇、甘油、枸橼酸和水。处方组成中的甘油是作为
A. 着色剂
B. 助悬剂
C. 湿润剂
D. pH调节剂
E. 溶剂

正确答案：C。湿润剂

解析：本题考查注射剂的附加剂。布洛芬口服混悬剂处方分析：布洛芬-主药；甘油-润湿剂（C对）；羟丙基甲基纤维素-助悬剂（B错）；山梨醇-甜味剂；枸橼酸-pH调节剂（D错）；水-溶剂（E错）。